阳和汤的组成药物中，除麻黄白芥子外，其余是
A. 熟地、鹿角霜、炮姜、桂枝、甘草
B. 熟地、鹿角胶、姜炭、肉桂、甘草
C. 熟地、龟板胶、干姜、肉桂、川芎
D. 生地、真阿胶、姜炭、桂枝、细辛
E. 熟地、鹿角胶、炮姜、细辛、甘草

正确答案：B。熟地、鹿角胶、姜炭、肉桂、甘草

解析：阳和汤方含熟地黄、麻黄、鹿角胶、白芥子、肉桂、生甘草、炮姜炭（B对），可温阳补血，散寒通滞。方歌：阳和汤法解寒凝，贴骨流注鹤膝风，熟地鹿胶姜炭桂，麻黄白芥甘草从。